经查实，某市一食品检验机构违反食品安全法，出具虚假检验报告。则其可能受到的处罚不包括
A. 撤销该食品检验机构的检验资质
B. 没收所收取的检验费用
C. 处检验费用5倍以上10倍以下罚款
D. 责令改正，给予警告
E. 对食品检验机构直接负责的主管人员开除的处分

正确答案：D。责令改正，给予警告